龈上牙石易沉积于
A. 上前牙唇面
B. 上颌双尖牙颊面
C. 上颌第一磨牙颊面和下前牙舌面
D. 上前牙邻面
E. 下前牙唇面

正确答案：C。上颌第一磨牙颊面和下前牙舌面

解析：本题考查龈上结石。龈上牙石易沉积于上颌第一磨牙颊面和下前牙舌面（C对）。沉积在临床牙冠，直接可看到的牙石称为龈上牙石，呈黄色或白色。龈上牙石易沉积于上颌第一磨牙颊面和下前牙舌面，因为它们分别与腮腺导管开口和舌下腺导管口相对。龈上牙石的矿化成分来源于唾液，上前牙唇面（A错）、邻面（D错）和下前牙唇面（E错）不被唾液浸泡，不易形成牙石；上颌双尖牙颊面（B错）距离唾液腺导管开口较远且刷牙时容易清洁，不容易形成牙石。